具有行气调中止痛功效的药物是
A. 柿蒂
B. 木香
C. 香附
D. 乌药
E. 薤白

正确答案：B。木香

解析：木香的功效是行气止痛，健脾消食（B对）。柿蒂（A错）的功效是降逆止呃。香附（C错）的功效是疏肝解郁，理气宽中，调经止痛。乌药（D错）的功效是行气止痛，温肾散寒。薤白（E错）的功效是通阳散结，行气导滞。